患者，男，58岁，高血压病史5年；吸烟史40年，日均40支。6小时前出现左侧肢体无力，并逐渐加重，不能站立；家属发现其说话迟钝，言语含混，右侧嘴唇变浅；意识清楚。到某院急诊，BP190/120mmHg；血常规基本正常，行头部MRI检查后，诊断为急性脑梗死。该患者首选的治疗方案是
A. 华法林3mg qd po
B. 氯吡格雷片75mg qd po
C. 阿司匹林肠溶片100mg qd po
D. 阿司匹林300mg st po
E. 注射用阿替普酶0.9mg/kg iv

正确答案：E。注射用阿替普酶0.9mg/kg iv

解析：本题考查急性脑梗死的首选治疗方案。注射用阿替普酶0.9mg/kg iv（E对）为急性脑梗死的首选治疗方案。华法林（A错）适用于预防和治疗血栓栓塞性疾病。对于不符合溶栓适应证且无抗血小板治疗禁忌症的急性脑梗死患者在发病后应尽早给予阿司匹林，推荐剂量150～300mg/d（D错），急性后期改为预防剂量50～150mg/d（C错）。对不能耐受阿司匹林者，可考虑选用氯吡格雷（B错）等抗血小板治疗。